不是妊娠期高血压疾病的高危因素的是
A. 孕妇年龄过小或大于40岁
B. 过期妊娠
C. 多胎妊娠
D. 糖尿病与肥胖
E. 抗磷脂抗体综合征

正确答案：B。过期妊娠

解析：妊娠期高血压疾病的高危因素①初产妇；②孕妇年龄过小或大于40岁；③多胎妊娠；④妊娠期高血压病史及家族史；⑤慢性高血压；⑥慢性肾炎；⑦抗磷脂抗体综合征；⑧糖尿病与肥胖（BMI≥35kg/m2）；⑨妊娠间隔时间≥10年；⑩孕早期收缩压≥130mmHg或舒张压≥80mmHg。以上因素均与该病的发生密切相关。掌握“娠期高血压疾病”知识点。